属于人际水平的健康行为改变理论的是
A. 健康信念模式
B. 社会认知理论
C. “知-信-行”理论
D. 创新扩散理论
E. 社区组织理论

正确答案：B。社会认知理论

解析：常用的健康行为理论可分为个体、人际、社区和群体三个水平，属于人际水平的健康行为改变理论的是社会认知理论（B对）；健康信念模式（A错）属于个体水平；创新扩散理论（D错）和社区组织模型（E错）属于社区和群体水平。“知-信-行”理论（C错）教材未明确提及。